小儿易患疳病的原因是
A. 脏腑娇嫩
B. 发育迅速
C. 肺常不足
D. 脾常不足
E. 肾常虚

正确答案：D。脾常不足

解析：疳证是由于喂养不当或多种疾病影响，导致脾胃受损，气液耗伤而形成的一种慢性疾病。脾主运化，胃主受纳，二者共司食物的消化、吸收及其精微物质的输布，以营养全身，故脾胃失和，则气血不足，津液亏耗，全身肌肤、筋骨、经脉、脏腑失于濡养，日久易形成疳证。正如《小儿药证直诀·诸疳》所说：“疳皆脾胃病，亡津液之所作也”（D对）。脏腑娇嫩（A错）为小儿的生理特点之一，指机体脏腑的形态未曾成熟。发育迅速（B错）为小儿的生理特点之一，指小儿的机体无论是在形态结构或生理功能方面，都在不断地、迅速地发育成长。肺常不足（C错）指腠理不密，卫外不固，易为外邪所犯，引发感冒、咳嗽、肺炎、哮喘等肺系疾病。肾常虚（E错）关系到小儿骨、脑、发、耳、齿的功能及形态，关乎生长发育和性功能成熟，可引起五软、遗尿等肾系疾病。